脏腑阴虚的共同症状是
A. 心悸失寐
B. 干咳痰少
C. 饥不欲食
D. 眩晕目涩
E. 舌红少津

正确答案：E。舌红少津

解析：机体阴虚，体内阴液亏少，则机体失却濡润滋养，同时由于阴不制阳，则阳热之气相对偏旺而生内热，故表现出一派虚热、干燥不润、虚火内扰的证候，故舌红少津（E对）。阴液亏少，心失濡养，心动失常，故见心悸；心神失养，虚火扰神，神不守舍，则见失眠。故心悸失寐见于心阴虚证（A错）。肺阴不足，失于滋润，肺失清肃，气逆于上，则干咳无痰，或痰少而黏。由此得出选项B为肺阴虚的症状（B错）。胃阴失滋，纳化迟滞，则饥不欲食，故选项C是胃阴虚的症状（C错）。肝阴不足，头目失濡，故头晕眼花，两目干涩。选项D是肝阴虚的症状（D错）。